唇的解剖位置中，唇的下界为
A. 鼻面沟
B. 唇面沟
C. 颏唇沟
D. 鼻唇沟
E. 鼻小柱

正确答案：C。颏唇沟

解析：唇的上界为鼻底，下界为颏唇沟。掌握“面部表面解剖”知识点。